可引起射血分数增大的因素是
A. 心室舒张末期容积增大
B. 动脉血压升高
C. 心率减慢
D. 心肌收缩能力增强
E. 快速射血相缩短

正确答案：D。心肌收缩能力增强